宜于餐后1～2小时服用的抗酸药是
A. 奥美拉唑
B. 地塞米松
C. 枸橼酸铋钾
D. 阿托品
E. 三硅酸镁

正确答案：E。三硅酸镁

解析：本题考查抗酸药的服用时间。餐后1～2小时口服的抗酸药包括：碳酸氢钠、碳酸钙、氢氧化铝、三硅酸镁（E对）、碳酸镁、铝碳酸镁、氧化镁及复方制剂。